残冠是指
A. 遗留牙槽窝中时间较久的牙根
B. 拔牙术中折断的牙根，拔除较为复杂
C. 牙齿由于龋坏等原因而致使牙冠的大部分缺损
D. 由于邻牙、骨或软组织的阻碍而只能部分萌出或完全不能萌出，且以后也不可能萌出的牙
E. 牙冠外层的白色半透明的钙化程度最高的坚硬组织

正确答案：C。牙齿由于龋坏等原因而致使牙冠的大部分缺损

解析：牙齿由于龋坏等原因而致使牙冠的大部分缺损，称为残冠。掌握“牙根拔除术”知识点。